芍药甘草汤与西药解痉药联用可
A. 协同增效
B. 消除腹胀
C. 消除便秘
D. 减少西药用量
E. 降低药物疗效

正确答案：A、B、C。协同增效；消除腹胀；消除便秘